葡萄球菌食物中毒的好发食品是
A. 奶及奶制品
B. 鱼虾蟹贝类等
C. 禽蛋类
D. 面包，面条等食品
E. 臭豆腐，豆酱等

正确答案：A。奶及奶制品

解析：葡萄球菌食物中毒食品种类：常见于奶及奶制品、蛋类、和各类熟肉制品等。掌握“食品安全”知识点。